患者查体发现尿糖（﹢﹢﹢），为明确诊断，应进一步检查
A. 24小时尿糖定量
B. 空腹血糖
C. 血脂
D. 肾功能
E. 葡萄糖耐量试验

正确答案：B。空腹血糖

解析：患者出现尿糖强阳性，可能为糖尿病或一过性尿糖。为鉴别诊断，参照糖尿病的诊断标准：有糖尿病症状加任意时间血糖≥11.1mmol/L，或FPG≥7.0mmol/L，或OGTT2小时PG≥11.1mmol/L，应多次检查空腹血糖（B对），因为空腹血糖检查简便易操作，可重复多次测定，防止假阳性。24小时尿糖定量（A错）、血脂（C错）、肾功能（D错）不是明确诊断糖尿病的进一步检查；对新发现的尿糖阳性，不适宜首选葡萄糖耐量试验（E错）。